子宫腺肌病主要表现为
A. 子宫增大，质软
B. 子宫增大，质硬
C. 子宫增大，伴有进行性加重痛经
D. 子宫增大，伴有突然下腹部疼痛
E. 以上均不是

正确答案：C。子宫增大，伴有进行性加重痛经

解析：子宫腺肌病的临床主要表现为经量增多、经期延长、不规则出血及继发性、进行性加剧的痛经，可导致不孕。常在经前一周开始下腹正中疼痛，直至月经结束。妇科检查时子宫呈均匀性增大或有局限性结节隆起，质硬有压痛，经期压痛尤著（C对）。